患者谈话言语单调，概念数量减少。以上临床表现属于什么症状
A. 思维奔逸
B. 思维散漫
C. 思维贫乏
D. 思维中断
E. 思维迟缓

正确答案：C。思维贫乏

解析：该患者谈话言语单调，概念数量减少（寡言少语，言语内容空洞单调）为思维贫乏症状（C对）。思维奔逸的患者感到脑子特别灵活，就像机器加了“润滑油”（A错）。思维散漫的患者联想松弛，内容散漫，缺乏主题，说话东拉西扯，以至于别人弄不懂患者所要阐述的主题思想是什么（B错）。思维中断患者在无意识障碍，又无外界干扰时，表现为言语突然停顿，片刻之后又重新开始，但所谈主题已经转换（D错）。思维迟缓的患者则感到脑子就像生了锈的机器，变笨了反应变慢了（E错）。